滴虫、细菌、真菌引起的混合感染阴道炎宜选用
A. 咪康唑
B. 甲硝唑
C. 庆大霉素
D. 聚甲酚磺醛
E. 曲古霉素

正确答案：D。聚甲酚磺醛

解析：本题考查阴道炎治疗药。滴虫、细菌、真菌引起的混合感染阴道炎宜选用聚甲酚磺醛（D对）。咪康唑（A错）用于真菌性阴道炎的治疗。甲硝唑（B错）用于滴虫性阴道炎的治疗。庆大霉素（C错）适用于敏感革兰阴性杆菌，如大肠埃希菌、克雷伯菌属、铜绿假单胞菌以及葡萄球菌甲氧西林敏感株所致的严重感染，如败血症等。曲古霉素（E错）用于滴虫、阿米巴原虫及念珠菌混合感染阴道炎。